某男，45岁。消渴病史2年，症见头晕耳鸣、腰膝酸软、骨蒸潮热、盗汗遗精。医师处以六味地黄丸。患者服上药后，症情稳定。2月后，患者又来就诊，症见潮热盗汗、咽干咳血、眩晕耳鸣、腰膝酸软。宜选用的成药是
A. 河车大造丸
B. 知柏地黄丸
C. 十全大补丸
D. 麦味地黄丸
E. 玉泉丸

正确答案：D。麦味地黄丸

解析：本题考查的是麦味地黄丸的主治。症见潮热盗汗、咽干咳血、眩晕耳鸣、腰膝酸软。宜选用的成药是麦味地黄丸（D对）。麦味地黄丸：【主治】肺肾阴亏，潮热盗汗，咽干咳血，眩晕耳鸣，腰膝酸软，消渴。河车大造丸（A错）：【主治】肺肾两亏，虚劳咳嗽，骨蒸潮热，盗汗遗精，腰膝酸软。知柏地黄丸（B错）：【主治】阴虚火旺，潮热盗汗，口干咽痛，耳鸣遗精，小便短赤。十全大补丸（C错）：【主治】气血两虚，面色苍白，气短心悸，头晕自汗，体倦乏力，四肢不温，月经量多。玉泉丸（E错）：【主治】阴虚内热所致的消渴，症见多饮、多食、多尿；2型糖尿病见上述证候者。